来源于伞形科植物的是
A. 白芷
B. 川芎
C. 两者都是
D. 两者都不是

正确答案：C。两者都是

解析：本题考查的是白芷与川芎的来源。来源于伞形科植物的是白芷与川芎（C对）。白芷（A错）：【来源】伞形科植物白芷或杭白芷的干燥根。川芎（B错）：【来源】伞形科植物川芎的干燥根茎。